易致肿疡的邪气是
A. 风
B. 寒
C. 湿
D. 燥
E. 火

正确答案：E。火

解析：火热为阳邪，其性炎上；火热易扰神；火热易伤津耗气；火热易生风动血；火邪易致疮痈，火邪入于血分，可聚于局部，腐蚀血肉，发为痈肿疮疡（E对）。风为阳邪，轻扬开泄，易袭阳位；风性善行而数变，病位游移，行无定处；风性主动；风为百病之长（A错）。寒为阴邪，易伤阳气；寒性凝带主痛，疼痛较剧；寒性收引（B错）。湿为阴邪，易伤阳气，易阻气机；湿性重浊；湿性黏滞；湿性趋下，易袭阴位（C错）。燥性干涩，易伤津液；燥易伤肺（D错）。